发生于口腔颌面部的血管瘤约占全身血管瘤的
A. 0.1
B. 0.2
C. 0.4
D. 0.6
E. 0.7

正确答案：D。0.6

解析：发生于口腔颌面部的血管瘤约占全身血管瘤的60%，其中大多数发生于面颈部皮肤，皮下组织，极少数见于口腔黏膜。深部及颌骨内的血管瘤日前认为应属血管畸形。掌握“血管瘤与脉管畸形”知识点。